下列属于政府定价的药品是
A. 国家基本药物
B. 处方药
C. 甲类非处方药
D. 国家储备药品
E. 国家基本医疗保险药品

正确答案：E。国家基本医疗保险药品